以下有关残根、断根说法中不正确的是
A. 遗留牙槽窝中时间较久的牙根为残根
B. 根钳拔除法适用于低位残根
C. 残根在根尖周和牙槽骨壁间，多存在慢性炎症及肉芽组织，根尖、牙周膜及牙槽骨壁均有程度不等的吸收
D. 断根是指拔牙术中折断的牙根
E. 断根拔除相对较为复杂

正确答案：B。根钳拔除法适用于低位残根

解析：根钳拔除法适用于高位残根，颈部折断的断根或虽折断部位低于牙槽嵴，但在去除少许牙槽骨壁后，仍能用根钳夹住的断根。牙挺取根法适用于根的折断部位比较低，根钳无法夹住时，应使用牙挺将其挺出。掌握“牙根拔除术”知识点。